不属于生物地球化学性疾病流行特点的是
A. 农村多发于城市
B. 与微量元素的地质化学分布有关
C. 市场经济的发达程度
D. 渔民高发
E. 沿海地区发病少

正确答案：D。渔民高发

解析：本题考查生物地球化学性疾病的流行特点。生物地球化学性疾病是由于地壳表面化学元素分布的不均匀性，使某些地区的水和（或）土壤中某些元素过多或过少，当地居民通过饮水、食物等途径摄入这些元素过多或过少，而引起某些特异性疾病。其流行特点有明显的地区性分布，表现为：农村多发于城市（A对）；沿海地区发病少（E对）。此外，生物地球化学性疾病还与微量元素的地质化学分布（B对）以及市场经济的发达程度（C对）有关。渔民高发（D错，为本题正确答案）不是生物地球化学性疾病的流行特点。